瘀血引起的崩漏，治疗宜选用的治法是
A. 塞因塞用
B. 通因通用
C. 补气摄血
D. 清热凉血
E. 热者寒之

正确答案：B。通因通用

解析：瘀血引起的崩漏，若用止血药，瘀阻会更加严重，导致出血不止；若用活血化瘀药，瘀血袪除则血自归经，出血就会停止，故宜选用通因通用的治法（B对）。塞因塞用适用于正气虚弱、运化无力所致真实假虚证（A错）；补气摄血适用于出血的病证（C错）；清热凉血用于治疗湿热毒瘀蕴结证（D错）；热者寒之即以寒药治疗热证（E错）。